人体氟主要分布在
A. 牙
B. 骨
C. 血液
D. 唾液
E. 以上说法均正确

正确答案：E。以上说法均正确

解析：人体氟主要分布于骨、牙、血液、唾液和菌斑中。掌握“人体氟摄入及代谢、氟防龋”知识点。